在阴阳学说中，“益火之源，以消阴翳”治疗原则是
A. 阴病治阳
B. 阳病治阴
C. 阴中求阳
D. 阳中求阴
E. 阴阳双补

正确答案：A。阴病治阳

解析：本题考查的是阴阳学说在疾病治疗中的应用。在阴阳学说中，“益火之源，以消阴翳”治疗原则是阴病治阳（A对）。阴阳失调的基本病机是阴阳偏盛和阴阳偏衰。阴阳偏盛，又称“阴阳偏胜”，即阴或阳的过盛有余，为邪气有余之实证。阴阳偏盛的治疗原则是“损其有余”“实则泻之”。阳盛则热属实热证，宜用寒凉药以制其阳，治热以寒，即“热者寒之”。阴盛则寒属实寒证，宜用温热药以制其阴，治寒以热，即“寒者热之”。若其相对一方出现偏衰时，则当兼顾其不足，配合以扶阳或益阴之法。阴阳偏衰，即阴或阳的虚损不足，或为阴虚，或为阳虚。阴阳偏衰的治疗原则是“补其不足”“虚则补之”。阴虚不能制阳而致阳亢者，属虚热证，一般不能用寒凉药直折其热，须“壮水之主，以制阳光”，即用滋阴壮水之法以抑制阳亢火盛，这种治疗原则亦称为“阳病治阴（B错）”。若阳虚不能制阴而造成阴盛者，属虚寒证，不宜用辛温发散药以散阴寒，须“益火之源，以消阴翳”，即用扶阳益火之法以消退阴盛，这种治疗原则也称为“阴病治阳”。对阴阳偏衰的治疗，明代张景岳根据阴阳互根的原理，提出了阴中求阳（C错）、阳中求阴（D错）的治法，即是指在用补阳药时，须佐用补阴药；在用补阴药时，须佐用补阳药，以发挥其互根互用的生化作用。阴阳双补（E错）指补阴药与补阳药同用。